胃溃疡常好发于
A. 贲门部
B. 胃底部
C. 胃大弯
D. 胃小弯
E. 胃体后壁

正确答案：D。胃小弯

解析：胃溃疡常好发于胃小弯（占50％～60％）（D对），其次为幽门管或幽门前（占20％）、贲门部（5％）（A错）等。胃底部（B错）、胃大弯（C错）、胃体后壁（E错）也可发生胃溃疡，但不常见。